男。40岁、乏力、反复牙龈出血及皮肤出血点1年。乙型肝炎病史10余年。查体：左肋下可触及包块，边界清，质地韧，有切迹。随呼吸移动，无压痛。该包块可能是
A. 左肾
B. 胰腺癌
C. 脾脏
D. 胃癌
E. 肝脏左叶

正确答案：C。脾脏

解析：患者乙肝病史10余年，乏力、反复牙龈出血及皮肤出血点1年，查体发现左肋下可触及包块，边界清，质地韧，有切迹。随呼吸移动，无压痛，考虑肝硬化。导致肝硬化的病因有10余种，我国目前仍以乙型肝炎病毒 （HBV）为主。患者存在10余年乙肝病史，并有肝功能减退相关症状，如反复牙龈出血及皮肤出血点，与肝合成凝血因子减少和脾功能亢进有关。脾大是由于肝硬化导致门脉高压，脾静脉回流阻力增加及门静脉压力逆传到脾，使脾脏被动淤血性肿大，脾组织和脾内纤维组织增生，因此，左肋下包块很有可能为肿大的脾脏（C对）。